患者，女，24岁。口干渴，消痩2年，用胰岛素治疗好转。因故停药3天，出现恶心呕吐，神志不清。急查：尿糖（﹢﹢﹢），血糖28mmol/L，血液pH7.2，脱水貌。治疗应首选
A. 补液、纠正电解质平衡紊乱，清开灵注射液滴注
B. 补液、纠正电解质平衡紊乱，安宫牛黄丸开水化服
C. 补液、纠正电解质及酸碱平衡紊乱，注射胰岛素
D. 补碱、补液和纠正电解质平衡紊乱
E. 滴注中枢兴奋剂、足量胰岛素

正确答案：C。补液、纠正电解质及酸碱平衡紊乱，注射胰岛素

解析：患者患有糖尿病，现恶心呕吐，神志不清，尿糖（﹢﹢﹢），血糖28mmol/L，血液pH7.2，脱水貌。所以，应以补液、纠正电解质及酸碱平衡紊乱，患者有糖尿病史，胰岛素亦不能停用（C对）。患者血糖增高，故应注射胰岛素以降血糖，补液、纠正电解质平衡紊乱，清开灵注射液滴注（A错）。补液、纠正电解质平衡紊乱，安宫牛黄丸开水化服（B错）。补碱、补液和纠正电解质平衡紊乱（D错）。患者酸碱水液代谢紊乱，故应予以纠正，滴注中枢兴奋剂、足量胰岛素（E错）。